男性，16岁，发热10天伴食欲减退，软弱。体检：体温39.6℃，脉搏74次/分，肝肋下2.0cm，脾肋下1.0cm。WBC2.6×10⁹/L，N0.85，L0.14，嗜酸粒细胞0.01，临床上拟诊为伤寒，为确定诊断对该患者应选用下列哪一种培养
A. 粪便培养
B. 血培养
C. 尿液培养
D. 胆汁培养
E. 玫瑰疹刮取物培养

正确答案：B。血培养

解析：16岁男性患者，发热10天伴食欲减退，体弱，体检：体温39.6℃，脉搏74次/分（相对缓脉），肝肋下2.0cm，脾肋下1.0cm（肝脾大），WBC2.6×10⁹/L（正常参考值4～10×10⁹/L），N0.85（正常参考值0.5～0.7），L0.14（正常值0.2～0.4），嗜酸粒细胞0.01（正常值0.05～0.5），根据患者的临床表现和实验室结果，临床上拟诊为伤寒，患者持续发热10天说明在病程第1～2周，此时血培养阳性率最高，可达80%～90%，为确定诊断对该患者应选用血培养（B对）。粪便培养（A错）在第二周阳性率才逐渐升高，不用作早期诊断。尿培养（C错）初期多为阴性，病程第3～4周的阳性率仅为25%左右。胆汁（D错）为伤寒的最佳培养基而非细菌学检查。玫瑰疹刮取物培养（E错）在必要时亦可进行。